阿司匹林所致哮喘患者除只用沙丁胺醇外，还应该联合使用的药物是
A. 异丙托溴铵
B. 沙美特罗
C. 茶碱
D. 奥马珠单抗（抗IgE抗体）
E. 孟鲁司特

正确答案：E。孟鲁司特

解析：本题考查哮喘药物。孟鲁司特（E对）与沙丁胺醇联合使用用于阿司匹林所致哮喘。白三烯受体阻断剂通过调节白三烯的生物活性而发挥抗炎作用，同时可以舒张支气管平滑肌，是目前除糖皮质激素外唯一可单独使用的哮喘控制性药物，可作为轻度哮喘糖皮质激素的替代治疗药物和中至重度哮喘的联合治疗用药，尤适用于阿司匹林哮喘、运动型哮喘和伴有过敏性鼻炎哮喘患者的治疗，常用药物有孟鲁司特、扎鲁司特。异丙托溴铵（A错）与β₂受体激动剂联合应用，适用于夜间哮喘及痰多的患者。沙美特罗（B错）属长效β₂受体激动剂（LABA），不能单独用于哮喘的治疗，与糖皮质激素联合使用是目前常用的哮喘控制方案。茶碱（C错）是治疗哮喘的有效药物之一。奥马珠单抗（抗IgE抗体）（D错）主要用于吸入型糖皮质激素和LABA联合治疗后症状仍未控制且血清IgE水平增高的重症哮喘患者。